一项关于吸烟与肺癌关系的病例对照研究，研究结果表明OR为4.0，其意义是
A. 吸烟导致肺癌发生的概率为4%
B. 吸烟导致肺癌发生的危险是不吸烟者的4倍
C. 吸烟导致肺癌发生的危险比不吸烟者大4倍
D. 吸烟导致肺癌发生的危险是不吸烟者的96%
E. 吸烟导致肺癌发生的危险是不吸烟者的3倍

正确答案：B。吸烟导致肺癌发生的危险是不吸烟者的4倍